生物性有毒有害物质的毒性
A. 包括一般毒性和特殊毒性
B. 主要产生神经毒性
C. 主要引起过敏反应
D. 主要是致癌性
E. 毒性一般低于环境污染物

正确答案：A。包括一般毒性和特殊毒性

解析：本题考查生物性有毒有害物质的相关内容。生物性有毒有害物质的种类很多，迄今被人类认识的可能只占少数。生物性有毒有害物质的毒性包括一般毒性和特殊毒性（A对BCDE错）。目前了解较多、毒害严重的主要有动物毒素和植物毒素